上肢肌按位置可分为肩肌、臂肌、前臂肌和手肌，数量较多，功能复杂，使上肢的运动复杂多样。既能运动肩关节，又能运动肘关节的肌是
A. 肱二头肌和旋前圆肌
B. 肱肌和胸大肌
C. 肱三头肌和喙肱肌
D. 肱二头肌和肱三头肌
E. 背阔肌和大圆肌

正确答案：D。肱二头肌和肱三头肌

解析：旋前圆肌（A错）使前臂旋前，并屈肘。肱肌（B错）屈肘关节。胸大肌（B错）使肩关节内收、旋内和前屈。喙肱肌（C错）使肩关节屈和内收。肱二头肌（D对）屈肘关节，并协助屈肩关节。肱三头肌（D对）伸肘关节，并协助伸及内收肩关节。背阔肌（E错）使肩关节后伸、内收及旋内。大圆肌（E错）使肩关节后伸、内收及旋内。